根据《药品不良反应报告和检测管理办法》，医疗机构发现可疑的药品不良反应，应当
A. 详细记录
B. 分析和处理
C. 回收销毁药品
D. 按规定报告
E. 通知供货单位和患者

正确答案：A、B、D。详细记录；分析和处理；按规定报告

解析：本题考查不良反应报告与处置。根据《药品不良反应报告和检测管理办法》，医疗机构发现可疑的药品不良反应，应当详细记录（A对）、分析和处理（B对）、按规定报告（D对）。《药品不良反应报告和监测管理办法》第三章报告与处置第二节个例药品不良反应第十九条：药品生产、经营企业和医疗机构应当主动收集药品不良反应，获知或者发现药品不良反应后应当详细记录、分析和处理，填写《药品不良反应／事件报告表》（见附表Ⅰ）并报告。